女，4岁。发热、呕吐1周，双眼呆滞1天。查体：消瘦明显，颈项强直。经治疗无效死亡。尸体解剖见脑膜血管扩张淤血，脑底蛛网膜下腔见灰白色胶样渗出物聚集，以脑桥、脚间池、视神经交叉处最明显，并见灰白色粟粒大小结节弥漫分布。镜下见渗出物中有淋巴细胞、单核细胞、纤维素及肉芽肿。最可能的诊断是
A. 流行性乙型脑炎
B. 化脓性脑脊髓膜炎
C. 真菌性脑膜炎
D. 结核性脑膜炎
E. 多发性脑脓肿

正确答案：D。结核性脑膜炎

解析：患者为4岁幼儿，出现发热、呕吐1周，双眼呆滞1天，查体：消瘦明显，颈项强直，治疗无效死亡，尸检见脑膜血管扩张淤血，脑底蛛网膜下腔见灰白色胶样渗出物聚集，以脑桥、脚间池、视神经交叉处最明显，并见灰白色粟粒大小结节弥漫分布，镜下见炎性细胞及肉芽肿，根据病史诊断为结核性脑膜炎（D对）。流行性乙型脑炎（A错）有高热、惊厥和意识障碍表现，尸检病变范围较广，从大脑到脊髓均可出现病理改变，其中以大脑、中脑、丘脑的病变最重。化脓性脑脊髓膜炎（B错）多以中性粒细胞为主，真菌性脑膜炎（C错）起病多呈亚急性，尸检可发现脑积水、脑水肿等。多发性脑脓肿（E错）尸检多有脑疝或脑室炎。